临床上，把患者对自己的精神疾病认识和判断能力称为
A. 观察力
B. 理解力
C. 想象力
D. 自知力
E. 自制力

正确答案：D。自知力

解析：患者对自己的精神状态的认识和判断能力为自知力（D对）。